根管和根尖周的感染是
A. 单纯需氧菌感染
B. 单纯厌氧菌感染
C. 以需氧菌感染为主的混合感染
D. 以厌氧菌感染为主的混合感染
E. 需氧菌和厌氧菌同样重要的混合感染

正确答案：D。以厌氧菌感染为主的混合感染

解析：本题考查根管和根尖周的感染。根管和根尖周的感染是以厌氧菌为主的混合感染（D对）。目前认为，根管和根尖周的感染是以厌氧菌为主的混合感染，厌氧菌在牙髓病和根尖周病的发生和发展中具有重要作用。引起牙髓根尖周病的厌氧菌以革兰氏阴性专性厌氧菌最多，占90%以上，其次还有少量的兼性厌氧菌和需氧菌。